牙隐裂后会出现
A. 牙髓充血的症状
B. 急性牙髓炎的症状
C. 急性根尖周炎的症状
D. 慢性牙髓炎的症状
E. 上述任一症状

正确答案：E。上述任一症状

解析：本题考查隐裂。隐裂纹达牙本质并逐渐加深的过程，可延续数年，并可先后出现牙本质过敏症、根周膜炎等症状；也可并发牙髓和根尖周病，如牙髓充血的症状（A对）、急性牙髓炎的症状（B对）、急性根尖周炎的症状（C对）、慢性牙髓炎的症状（D对）。隐裂达根分歧部或牙根尖部时，还可引起牙髓-牙周联合病变，最终可导致牙齿完全劈裂。上述任一症状均可能出现，因此选E。